炮制后能降低刺激性，增强宽中和胃作用的中药是
A. 黄柏
B. 厚朴
C. 甘草
D. 延胡索
E. 当归

正确答案：B。厚朴

解析：本题考查厚朴的炮制作用。炮制后能降低刺激性，增强宽中和胃作用的中药是厚朴（B对）。厚朴【炮制作用】厚朴味苦、辛，性温。归脾、胃、肺、大肠经。具有燥湿消痰、下气除满的功能。①生品辛味峻烈，对咽喉有刺激性，故一般内服都不生用。②姜厚朴可消除对咽喉的刺激性，并可增强宽中和胃的功效。多用于湿阻气滞，脘腹胀满或呕吐泻痢，积滞便秘，痰饮喘咳，梅核气。 黄柏（A错）【炮制作用】黄柏味苦，性寒。归肾、膀胱经。具有泻火解毒，清热燥湿的功能。多用于湿热泄痢，黄疸，热淋，足膝肿痛，疮疡肿毒，湿疹，烫火伤等。①盐黄柏可引药入肾，缓和枯燥之性，增强滋肾阴、泻相火、退虚热的作用。多用于阴虚发热，骨蒸劳热，盗汗，遗精，足膝痿软，咳嗽咯血等。②酒黄柏可降低苦寒之性，免伤脾阳，并借酒升腾之力，引药上行，清血分湿热。用于热壅上焦诸证及热在血分。③黄柏炭清湿热之中兼具涩性，多用于便血、崩漏下血。甘草（C错）【炮制作用】甘草味甘，性平。归心、肺、胃经。具有补脾益气，清热解毒，祛痰止咳，缓急止痛，调和诸药的功能。①生品味甘偏凉，长于泻火解毒，化痰止咳。多用于痰热咳嗽，咽喉肿痛，痈疽疮毒，食物中毒及药物中毒。②炙甘草甘温，以补脾和胃、益气复脉力胜。常用于脾胃虚弱，心气不足，脘腹疼痛，筋脉挛急，脉结代。延胡索（D错）【炮制作用】延胡索味辛、苦，性温。归肝、脾经。具有活血、利气、止痛的功能。用于胸胁、脘腹疼痛，经闭痛经，产后瘀阻，跌打肿痛等证。①生品止痛有效成分不易煎出，效果欠佳，故临床多用醋制品。②醋延胡索行气止痛作用增强，广泛用于身体各部位的多种疼痛证候。③酒延胡索以活血、祛瘀、止痛为主。当归（E错）【炮制作用】当归味甘、辛、性温。归肝、心、脾经。①生品质润，具有补血，调经，润肠通便的功能。传统习惯止血用当归头，补血用归身，破血用当归尾，补血活血用全当归。当归生用还可用于血虚萎黄，眩晕心悸，月经不调，肠燥便秘，痈疽疮疡。②酒炙当归，增强活血通经、祛瘀止痛的作用。用于经闭痛经，风湿痹痛，跌打损伤，瘀血肿痛。③土炒当归，既能增强入脾补血作用，又能缓和油润而不滑肠。可用于治疗血虚便溏，腹中时痛。④当归炭，具有止血和血作用。用于崩中漏下，月经过多。